按照我国常用烧伤严重程度分级，Ⅱ度烧伤但是面积不足10%属于下列哪个分度
A. 轻度烧伤
B. 中度烧伤
C. 重度烧伤
D. 特重烧伤
E. 以上选项均不正确

正确答案：A。轻度烧伤

解析：烧伤严重程度分度：①轻度烧伤：Ⅱ°烧伤面积10%以下（A对）；②中度烧伤（B错）：Ⅱ°烧伤面积11%～30%，或有Ⅲ°烧伤但面积不足10%；③重度烧伤（C错）：烧伤总面积31%～50%，或Ⅲ°烧伤面积11%～20%，或Ⅱ°、Ⅲ°烧伤面积虽不到上述百分比，但已发生休克等并发症，或存在较重的吸入性损伤、复合伤；④特重烧伤（D错）：烧伤总面积50%以上，或Ⅲ°烧伤20%以上。